女，35岁。停经80天，阴道不规则流血4天，下腹隐痛，呕吐反应剧烈，既往无孕产史。妇科检查：宫底平脐，质软，未触及胎体，未闻及胎心，尿hCG（+）。该患者首先考虑的诊断是
A. 稽留流产
B. 葡萄胎
C. 先兆流产
D. 绒毛膜癌
E. 侵蚀性葡萄胎

正确答案：B。葡萄胎

解析：患者为年轻女性，停经80天（怀疑早孕），阴道不规则流血4天（葡萄胎患者般在停经8～12周左右开始不规则阴道流血，量多少不定），下腹隐痛（因葡萄胎增长迅速和子宫过度快速扩张引起阵发性下腹痛，一般不剧烈，能忍受）。呕吐反应剧烈（提示早孕反应），妇科检查：宫底平脐（为22周左右的子宫大小，大于停经月份。因葡萄胎迅速增长及宫腔内出血，约半数以上患者的子宫大于停经月份，质地变软），质软，未触及胎体，未闻及胎心（葡萄胎患者B超检查，无妊娠囊或胎心搏动），尿hCG（+），应首先考虑的诊断是葡萄胎（B对）。先兆流产（P48）（C错）指妊娠28周前先出现少量阴道流血，随后出现阵发性下腹痛或腰背痛。妇检：子宫大小与停经周数相符。稽留流产（P49）（A错）又称过期流产，指胚胎或胎儿已死亡滞留宫腔内未能及时自然排出者。主要表现为胎动、胎心消失，子宫较停经周数小，质地不软。侵蚀性葡萄胎（E错）（P338）继发于葡萄胎妊娠，镜下可见水泡状组织侵入子宫肌层，有绒毛结构及滋养细胞增生和异型性。绒毛膜癌（D错）大体观见肿瘤侵入子宫肌层，与周围组织分界清，伴明显出血坏死。镜下见细胞滋养细胞和合体滋养细胞成片状高度增生，明显异型，不形成绒毛或水泡状结构。